患者，女，28岁。患急性乳腺炎10天，脓肿溃破，引流不畅，发热，纳差，舌苔薄黄，脉弦。治疗应首选
A. 瓜蒌牛蒡汤
B. 透脓散
C. 仙方活命饮
D. 归脾汤
E. 四妙汤

正确答案：B。透脓散

解析：患者，女，28岁患急性乳腺炎10天，诊断为急性乳腺炎，脓肿溃破，引流不畅，发热，纳差，舌苔薄黄，脉弦，诊断为热毒炽盛证，选用透脓散加减以清热解毒，托里透脓（B对）。治疗急性乳腺炎郁乳期需要疏肝清胃，通乳消肿，选用瓜萎牛蒡汤加减（A错）。仙方活命饮具有清热解毒，消肿散结，活血止痛之功效，主治阳证痈疡肿毒初起（C错）。归脾汤功效：养血安神，补心益脾，调经。主治：心脾气血两虚证（D错）。四妙散具有清热利湿，舒筋壮骨之功效，主治湿热痿证（E错）。